右冠状动脉主干走行于
A. 冠状沟
B. 前室间沟
C. 后室间沟
D. 界沟
E. 房间沟

正确答案：A。冠状沟

解析：冠状沟（A对）内有右冠状动脉主干走行，其起于主动脉的冠状动脉右窦，行于右心耳与肺动脉干之间。